为避免有畸形中央尖的牙发生牙体与牙周损伤，临床上应采用何种措施
A. 活髓切断术
B. 根尖诱导成形术
C. 磨除中央尖，开髓失活术
D. 少量多次调磨中央尖
E. 根管治疗术

正确答案：D。少量多次调磨中央尖

解析：本题考查畸形中央尖的治疗。为避免有畸形中央尖的牙发生牙体与牙周损伤，说明中央尖未折断，少量多次调磨中央尖即可（D对）。若中央尖折断，但未引起牙髓及根尖周病变时，应根据情况分别采用直接盖髓术、间接盖髓术或部分冠髓切断术（A错）。若中央尖折断引起的牙髓或根尖周病变时，为保存患牙并使牙根继续发育形成，应行根尖诱导成形术（B错），待牙根发育完全再行根管治疗术（E错）。处理中央尖时应尽量保留患牙牙髓，以使患牙牙根继续发育，不能采用开髓失活术（C错）。